具有推动呼吸和血行功能的气是
A. 心气
B. 肺气
C. 营气
D. 卫气
E. 宗气

正确答案：E。宗气

解析：心气具有推动血液运行的功能（A错）。肺气有宣发和肃降的功能，能推动人体的呼吸运动（B错）。营气的生理功能有化生血液和营养全身两个方面（C错）。卫气具有防御外邪、温养全身和调控腠理的生理功能（D错）。宗气具有行呼吸、行血气和资先天三个方面（E对）。